患者，女，30岁，妊娠7个月，既往有磺胺药过敏史。近日双眼沙眼症状加剧，发痒、分泌物多，有烧灼感。去年曾用酞丁安滴眼液治疗相似症状，疗效较好，今天到药店想再次购买该药。药师给予的用药建议是
A. 酞丁安滴眼液
B. 利巴韦林滴眼液
C. 磺胺醋酰钠滴眼液
D. 硫酸锌滴眼液
E. 醋酸可的松滴眼液

正确答案：D。硫酸锌滴眼液

解析：本题考查沙眼的药物治疗。硫酸锌滴眼液（D对）在低浓度时呈收敛作用，锌离子能沉淀蛋白，可与眼球表面和坏死组织及分泌物中的蛋白质形成极薄的蛋白膜，起到保护作用；高浓度则有杀菌和凝固作用，有利于创面及溃疡的愈合。酞丁安滴眼液（A错）对沙眼衣原体有强大的抑制作用，在沙眼包涵体尚未形成时，能阻止沙眼衣原体的繁殖和包涵体的形成，尤其对轻度沙眼疗效最好。育龄妇女慎用酞丁安滴眼液，妊娠期妇女禁用酞丁安滴眼液。该题中患者既往有磺胺药过敏史，因此不可选用磺胺醋酰钠滴眼液（C错）进行沙眼的治疗。利巴韦林滴眼液（B错）用于单纯疱疹病毒性角膜炎。醋酸可的松滴眼液（E错）用于过敏性结膜炎。禁用可的松眼药水治疗慢性沙眼，会加重病情。